采用比色法测定醋酸地塞米松注射液的含量，使用的试剂有
A. 亚硝基铁氰化钠
B. 硫酸
C. 氯化三苯四氮唑
D. 氢氧化四甲基铵
E. 二苯胺

正确答案：C、D。氯化三苯四氮唑；氢氧化四甲基铵